在根管治疗疗效评估观察的时间指定为术后
A. 1年
B. 2年
C. 3年
D. 4年
E. 5年

正确答案：B。2年

解析：在根管治疗后6个月、1年和2年进行复查，疗效指定时间为术后2年。掌握“疗效评定与牙体修复原则”知识点。